根据现行指导原则，生物等效性试验参数及其接受限度为：受试制剂与参比制剂AUC的几何均值比值的90%置信区间应落在接受范围之内，其范围是
A. 80%～120%
B. 70%～143%
C. 70%～130%
D. 80%～143%
E. 80%～125%

正确答案：E。80%～125%

解析：本题考查体内药物检测。根据现行指导原则，生物等效性试验参数及其接受限度为：受试制剂与参比制剂AUC的几何均值比值的90%置信区间应落在接受范围之内，其范围是80%～125%（E对）。